别嘌醇的临床应用
A. 感冒发热
B. 痛风
C. 心律失常
D. 高血压
E. 风湿性关节炎

正确答案：B。痛风

解析：本题考查别嘌醇的临床应用。别嘌醇能够抑制黄嘌呤氧化酶，阻止次黄嘌呤和黄嘌呤代谢为尿酸，从而减少尿酸的生成，可用于原发或继发性痛风（B对）。